有关大肠的描述,不正确的是
A. 包括盲肠、阑尾、结肠、直肠和肛管
B. 盲肠和结肠具有结肠带、结肠袋和肠脂垂
C. 结肠左曲以前的部分主要由肠系膜上动脉供血
D. 结肠左曲以后的部分主要由肠系膜下动脉供血
E. 大肠均为腹膜内位器官

正确答案：E。大肠均为腹膜内位器官

解析：大肠包括盲肠、阑尾、结肠、直肠和肛管(A对)，盲肠和结肠具有三个特征性结构，即结肠带，结肠袋和肠脂垂(B对)，结肠左曲以前即横结肠以前(包括横结肠)均由肠系膜上动脉的分支供血(C对)，如右结肠动脉和中结肠动脉，结肠左曲以后的部分由肠系膜下动脉分支供血(D对)，大肠中直肠上段为腹膜间位器官，直肠中下段为腹膜外位器官(E错)。